痛证或痰饮的常见脉象是
A. 代脉
B. 涩脉
C. 细脉
D. 弦脉
E. 迟脉

正确答案：D。弦脉

解析：本题考查的是弦脉与主病。痛证或痰饮的常见脉象是弦脉（D对）。弦脉与主病：［脉象］端直以长，如按琴弦。［主病］肝胆病、痛证、痰饮等。弦大兼滑，阳热为病；弦紧兼细，阴寒为病；虚劳内伤，中气不足，肝病乘脾，也常见弦脉；若弦而细劲，如循刀刃，便是全无胃气，病多难治。代脉（A错）与主病：［脉象］脉来缓弱而有规则的歇止，间歇时间较长。［主病］主脏气衰微。风证、痛证、七情惊恐、跌扑损伤诸病而见代脉，多属因病而致脉气不能衔接，与脏气衰微或“一脏无气”的代脉有所不同。涩脉（B错）与主病：［脉象］往来艰涩不畅，有如轻刀刮竹。［主病］气滞、血瘀、精伤、血少。细脉（C错）与主病：［脉象］脉来细小如线，软弱无力，但应指明显。［主病］气血两虚、诸虚劳损，又主湿病。迟脉（E错）与主病：［脉象］脉来迟慢，一息不足四至（相当于每分钟脉搏在60次以下）。［主病］主寒证。有力为冷积，无力为阳虚。